培养真菌的最适宜pH值是
A. pH1～2
B. pH3～4
C. pH4～6
D. pH7～8
E. pH9～10

正确答案：C。pH4～6

解析：真菌对营养的要求不高，常用沙保培养基培养。温度为22～28℃；但某些深部真菌最适生长温度为37℃；最适pH值为4.0～6.0。掌握“真菌概述及主要病原性真菌”知识点。